男，45岁。间断上腹痛腹胀伴嗳气8年。胃镜检查：胃窦黏膜粗糙，以白为主，黏膜活检病理提示慢性萎缩性胃炎伴中至重度肠上皮化生，快速尿素酶试验阳性，该患者首先应采用治疗是
A. 应用质子泵抑制剂
B. 应用促胃肠动力剂
C. 抗幽门螺杆菌治疗
D. 应用抗酸剂
E. 临床密切观察，必要时手术切除

正确答案：C。抗幽门螺杆菌治疗

解析：患者黏膜活检病理提示慢性萎缩性胃炎伴中至重度肠上皮化生（癌前状态），快速尿素酶试验阳性，提示幽门螺旋杆菌感染。治疗方法有：对因治疗（抗幽门螺杆菌治疗）；对症治疗；癌前状态处理；患者教育。其中对因治疗（抗幽门螺杆菌治疗）（C对）为首选方法，可予短期或长期间歇治疗。应用质子泵抑制剂（A错）、应用促胃肠动力剂（B错）和应用抗酸剂（D错）都是对症治疗，是次要的治疗措施。慢性萎缩性胃炎出现癌前状态首选药物治疗，只有对药物不能逆转的灶性重度不典型增生伴有局部淋巴结肿大时，才考虑手术治疗（E错）。